导致制剂中黄芩苷不稳定的主要原因是
A. 水解
B. 氧化
C. 聚合
D. 变旋
E. 晶型转换

正确答案：B。氧化

解析：本题考查的是中药药物制剂的化学不稳定性。导致制剂中黄芩苷不稳定的主要原因是氧化（B对）。药物制剂的化学不稳定性：化学不稳定性是指由于药物水解、氧化、还原、光解、异构化、聚合（C错）、脱羧等，以及药物相互作用产生的化学反应，使制剂中药物含量或效价发生变化。其中水解、氧化是主要化学降解途径。（1）易水解（A错）的药物类型：①酯类药物：具有酯键结构的药物较易水解，相对分子量小的脂肪族酯类极易水解，几乎无法制成稳定的液体制剂。酯类药物制成水溶液时要特别注意pH的调节。一般而言，溶液碱性愈强，水解愈快，如穿心莲内酯在pH7时内酯环水解极其缓慢，而在偏碱性溶液中则水解加快。②酰胺类药物：一般较酯类药物难水解，如青霉素等。③苷类药物：在酶或酸碱的作用下产生水解反应，水解的难易程度与构成苷类药物的糖、苷元的种类以及苷元和糖的连接方式有关。如强心苷易水解，故常以较高浓度的乙醇为溶剂，其注射剂多采用水与乙醇、丙二醇或甘油等混合溶剂。如洋地黄酊多采用70%乙醇浸出。（2）易氧化的药物类型：药物因接触空气中的氧，在常温下可发生氧化反应。易氧化的药物主要有：①具有酚羟基或潜在酚羟基的有效成分，如黄芩苷等；②含有不饱和碳链的油脂、挥发油等，在光线、氧气、水分、金属离子以及微生物等影响下，都能产生氧化反应。变旋（D错）为生物碱的理化性质。生物碱的旋光性受手性碳的构型、测定溶剂、pH、温度及浓度等的影响。如麻黄碱在水中呈右旋性，在三氯甲烷中则呈左旋性；烟碱在中性条件下呈左旋性，在酸性条件下则呈右旋性；北美黄连碱在95%以上乙醇中呈左旋性，在稀乙醇中呈右旋性，在中性条件下呈左旋性，在酸性条件下呈右旋性。混悬液受温度影响可发生晶型转换（E错）。温度影响药物微粒的溶解与结晶过程，可能导致结晶长大、晶型转变。因此混悬液一般应贮藏于阴凉处。